患者男性，32岁，因头昏、头痛、多汗、呕吐、腹痛、腹泻半小时来诊。半小时前午餐曾吃青菜和肉类。查体：呼吸18次/分，脉搏100次/分，血压120/70mmHg，多汗，瞳孔缩小，肺部偶有湿啰音，心脏无杂音，心律规则。最可能的诊断是
A. 细菌性食物中毒
B. 可溶性钡盐中毒
C. 有机磷杀虫剂中毒
D. 中暑
E. 菌痢

正确答案：C。有机磷杀虫剂中毒

解析：中青年男性患者，半小时前午餐曾进食肉类和青菜（青菜可有有机磷农药残留），出现头昏头痛、多汗、呕吐、腹痛、腹泻半小时，查体有多汗、瞳孔缩小、肺部有湿啰音（有机磷农药中毒典型毒蕈碱样症状和体征），考虑诊断为有机磷杀虫剂中毒（C对）。细菌性食物中毒（A错）可有不洁食物摄入史，多为集体发病。以急性胃肠炎症状为主，起病急，有恶心、呕吐、腹痛、腹泻等。腹泻严重者可导致脱水、酸中毒甚至休克。但无多汗、瞳孔缩小、肺部湿性啰音等毒蕈碱样症状。可溶性钡盐中毒（B错）多有吸入或食入氯化钡等病史，吸入或食入后2～3小时出现急性胃肠炎，重者引起低钾血症、四肢瘫痪、呼吸肌麻痹和心律失常，但无多汗、瞳孔缩小、肺部湿性啰音等毒蕈碱样症状。中暑（D错）多有高热环境工作史，可表现多汗、头晕、头痛、恶心、呕吐和肌痉挛，严重出现高热伴神志障碍（P918），但无瞳孔缩小、肺部湿性啰音等毒蕈碱样症状。菌痢（E错）起病急，体温可达39℃以上，伴头痛、乏力、食欲减退，并出现腹痛、腹泻，多先为稀水样便，1～2天后转为黏液脓血便，常伴肠鸣音亢进，左下腹压痛，但无肺部湿啰音及瞳孔缩小等毒蕈碱样症状。